治疗经行头痛肝火证，应首选方剂
A. 通窍活血汤
B. 羚角钩藤汤
C. 天麻钩藤饮
D. 镇肝熄风汤
E. 加味逍遥丸

正确答案：B。羚角钩藤汤

解析：经行头痛肝火证，治法清热平肝熄风，用羚角钩藤汤以平肝熄风，清热止痉（B对）。经行头痛血瘀证，治法化瘀通络，用通窍活血汤（A错）。天麻钩藤饮功用平肝熄风，清热活血，补益肝肾（C错）。镇肝熄风汤功用镇肝熄风，滋阴潜阳（D错）。加味逍遥丸舒肝清热，健脾养血，用于肝郁血虚，肝脾不和（E错）。